患者女性，36岁，劳累后心悸，气促12年，近年来常有心绞痛，偶有晕厥。检查：心脏叩诊向左下扩大，胸骨右缘可触及收缩期震颤并可闻及高调粗糙的递增-递减型收缩期杂音，血压120/60mmHg。应首先考虑的诊断是
A. 风湿性心脏病主动脉瓣关闭不全
B. 风湿性心脏病主动脉瓣狭窄
C. 先天性心脏病，主动脉瓣狭窄伴相对性肺动脉瓣关闭不全
D. 冠心病合并乳头肌功能不全
E. 梅毒性心脏病，主动脉瓣关闭不全

正确答案：B。风湿性心脏病主动脉瓣狭窄

解析：患者劳累后心悸、气促，检查示：心脏叩诊向左下扩大，胸骨右缘可触及收缩期震颤并可闻及高调粗糙的递增-递减型收缩期杂音，为典型的主动脉狭窄听诊杂音，故应首先考虑的诊断是风湿性心脏病主动脉瓣狭窄（B对）。风湿性心脏病主动脉瓣关闭不全时，心尖部第一心音减弱；主动脉瓣区第二心音减弱或消失；主动脉瓣第二听诊区可闻及叹气样递减型舒张期音，前倾位和深吸气更易听到，可向心尖部传导；重度关闭不全时，可在心尖区闻及舒张中期柔和低调隆隆样杂音，系反流血液冲击二尖瓣引起二尖瓣处于半关闭状态形成相对狭窄所致。可有动脉枪击音及杜氏双重杂音（A错）。先天性心脏病，主动脉瓣狭窄伴相对性肺动脉瓣关闭不全其临床表现主要取决于畸形的大小和复杂程度（C错）。二尖瓣乳头肌收缩功能障碍可产生二尖瓣脱垂并关闭不全，引起心力衰竭。乳头肌腱索整体断裂少见，多发生在二尖瓣后乳头肌，心力囊竭明显，可迅速发生肺水肿而迅速死亡（D错）。梅毒性心脏病由于患梅毒后没有彻底的治愈而引起梅毒性心脏病，常在患梅毒后10～20年发病。梅毒性心脏病是指梅毒螺旋体进入主动脉外层，导致主动脉炎，产生主动脉瘤、冠状动脉瘤、冠状动脉口狭窄和主动脉关闭不全等病变，并引起相应的临床表现（E错）。